按《素问·刺热》面部分候法，候脾的部位是
A. 额部
B. 鼻部
C. 左颊
D. 右颊
E. 颏部

正确答案：B。鼻部

解析：本题考查面部脏腑分候理论。《内经》关于面部分候脏腑的方法主要有两种：一种为《灵枢·五色》所提出的对面部的不同部位进行命名，分别配属不同脏腑；另一种是《素问·刺热》提出的面部分候五脏法：额部候心（A错）、鼻部候脾（B对）、左颊候肝（C错）、右颊候肺（D错）、颏部候肾（E错）。